一新生儿暴发脓毒血症，脓汁标本经涂片革兰染色镜检发现葡萄球菌。试问为确定该菌是否有致病力，应检查哪一种酶
A. 凝固酶
B. 触酶
C. DNA酶
D. 尿素酶
E. 卵磷脂酶

正确答案：A。凝固酶